医师进行试验性临床医疗，应当
A. 经医院批准
B. 征得本人同意
C. 征得患者本人或者其家属同意
D. 经医院批准并征得患者本人或者其家属同意
E. 经医院批准或者征得患者本人及家属同意

正确答案：D。经医院批准并征得患者本人或者其家属同意

解析：医师应当如实向患者或家属介绍病情，但应注意避免对患者产生不利后果。医师进行实验性临床医疗，应当经医院批准并征得患者本人或者家属同意。掌握“医师执业规则及培训、考核及法律责任”知识点。